牙周维护期菌斑控制的主要方法是
A. 组织修复
B. 定期服用抗菌药物
C. 使用含氟牙膏
D. 服用牙周宁
E. 正确刷牙、使用牙线

正确答案：E。正确刷牙、使用牙线

解析：本题考查牙周维护期菌斑控制的方法。牙周维护期强化与患者的沟通和菌斑控制 ，在行之有效的预防和控制牙周病的方法中，机械性菌斑控制仍是首选的方法，因为其直接去除了疾病的始发因素-聚集于牙表面的病原微生物。患者自我控制菌斑常用的机械性方法是正确刷牙、使用牙线（E对）。常使用抗菌漱口液（A错）只能抑制部分菌斑的致病作用。定期服用抗菌药物（B错）会引起菌群失调和耐药性，同时菌斑不去除牙周健康很难维护。使用含氟牙膏（C错）有防龋作用，也有一定清洁作用，菌斑控制关键在于经常刷牙。服用牙周宁（D错）对菌斑控制的作用很小，且长期用药会产生副作用。